当阻滞麻醉镇痛效果不全时，常加用下列哪种方法可取得较好的效果
A. 冷冻麻醉
B. 表面麻醉
C. 骨膜上浸润麻醉
D. 牙周膜注射浸润麻醉
E. 针刺麻醉

正确答案：D。牙周膜注射浸润麻醉

解析：本题考查牙周膜注射法。阻滞麻醉是将局麻药注射到神经干或其主要分支附近，而牙周膜注射浸润麻醉（D对）目标不是在神经干，而是麻醉具体部位，常可取得较好的镇痛效果。冷冻麻醉（A错）属表面麻醉（B错），仅使用于表浅的黏膜下脓肿的切开引流、松动牙的拔出等，不能达到牙周膜注射浸润麻醉的效果。骨膜上浸润（C错）主要用于上颌及下颌前份牙及牙槽突的手术，麻醉范围局限，在效果上也不能代替牙周膜注射浸润麻醉。针刺麻醉（E错）常常麻醉不全，且个体差异较大，不属于口腔颌面外科临床常用麻醉方法。